根据药品管理法法定要求，未强制要求药品经营企业执行的是
A. 进货检查验收制度
B. 药品入库和出库检查制度
C. 药品效期管理制度
D. 药品保管制度
E. 药品内在质量检验制度

正确答案：E。药品内在质量检验制度

解析：本题考查药品经营企业经营行为的规定。根据药品管理法法定要求，未强制要求药品经营企业执行的是药品内在质量检验制度（E错，为本题正确答案）。药品经营企业购进药品，必须建立并执行进货检查验收制度（A对），验明药品合格证明和其他标识；不符合规定要求的，不得购进。药品入库和出库必须执行检查制度（B对）。医疗机构应当建立药品效期管理制度（C对）。药品发放应当遵循“近效期先出”的原则。药品经营企业必须制定和执行药品保管制度（D对），采取必要的冷藏、防冻、防潮、防虫、防鼠等措施，保证药品质量。